胸膜摩擦音听诊的时相特点为
A. 吸气初期
B. 吸气中期
C. 吸气末期
D. 呼气期
E. 呼吸两相

正确答案：E。呼吸两相

解析：正常胸膜表面光滑，胸膜腔内并有微量液体存在，因此呼吸时胸膜脏层和壁层之间相互滑动并无音响产生。当胸膜由于炎症或者纤维素渗出而变得粗糙时，则随着呼吸便可出现胸膜摩擦音。胸膜摩擦音通常于呼吸两相（E对）均可听到，而且十分近耳，一般于吸气末或呼气初较为明显，屏气时消失。